贯众具有的功效是
A. 止血
B. 止泻
C. 止呕
D. 止咳
E. 止痒

正确答案：A。止血

解析：该题考查贯众的功效，属记忆内容。贯众味苦，性微寒；有小毒；入肝、脾经；具有清热解毒，凉血止血，杀虫的功效（A对BCDE错）。